胸膜粘连最常见的是
A. 肺尖部胸膜
B. 肋膈角处
C. 心膈角处
D. 纵隔胸膜
E. 叶间胸膜

正确答案：B。肋膈角处

解析：胸膜轻度增厚时X线表现为肋膈角变钝或消失。广泛胸膜肥厚则呈大片不均匀性密度增高影，并可使纵隔移向患侧。患侧胸廓塌陷，膈肌升高，胸椎弯曲侧凸，故胸膜粘连最常见的是肋膈角处（B对）。